下列论述不正确的是
A. 机体代谢活动必须有适宜的酸碱度
B. 所需的酸碱度波动范围很窄
C. 机体不断地排出酸性和碱性物质
D. 机体代谢过程中产生少量的酸性物质
E. 正常动脉血pH平均值为7.40

正确答案：D。机体代谢过程中产生少量的酸性物质

解析：机体代谢活动必须有适宜的酸碱度（A对），但是所需的酸碱度波动范围很窄（B对），所以机体依靠体内各种缓冲系统以及肺和肾的调节功能来使PH保持稳定，故正常动脉血pH平均值为7.40（E对）。正常条件下，机体不断排出并摄入酸性和碱性物质（C对），但是在普通膳食条件下，体内代谢所产生的酸性物质远远超过碱性物质（D错，为本题正确答案）。